是损伤了
A. 左迷走神经
B. 右迷走神经
C. 右舌咽神经
D. 右舌下神经
E. 左舌咽神经

正确答案：B。右迷走神经

解析：右迷走神经经过右锁骨下动脉前方处时发出右喉返神经，由前向后绕过右锁骨下动脉返回向上，支配右侧声带肌。因而右侧声带肌麻痹发音嘶哑，是损伤了右迷走神经（B对）。左迷走神经（A错）损伤则导致左侧声带肌麻痹发音嘶哑。舌咽神经（CE错）损伤导致咽部感觉减退或丧失、咽反射消失、舌后1/3味觉丧失和咽肌轻度瘫痪。右舌下神经（D错）损伤导致伸舌时舌尖偏向右侧。